现况研究资料的主要分析指标是
A. 患病率
B. 比值比
C. 相对危险度
D. 某病病死率
E. 某病死亡人数

正确答案：A。患病率

解析：本题考查现况研究的分析指标。现况研究是通过对特定时点和特定范围内人群中的疾病或健康状况和有关因素的分布状况的资料收集、描述，从而为进一步的研究提供病因线索。从观察分析指标来说，由于这种研究所得到的频率指标一般为特定时间内调查群体的患病率（A对BCDE错），故也称之为患病率研究。